儿少卫生领域筛查贫血的常用指标为
A. 红细胞数
B. 白细胞数
C. 血细胞比容
D. 血红蛋白浓度
E. 血小板数

正确答案：D。血红蛋白浓度